山药粉末的显微特征之一是
A. 石细胞
B. 晶纤维
C. 草酸钙针晶束
D. 木栓细胞
E. 油细胞

正确答案：C。草酸钙针晶束